牙本质湿粘接能提高粘接强度的主要原因是
A. 能够与管间牙本质粘接
B. 能够与管周牙本质粘接
C. 形成树脂突与牙本质小管嵌合
D. 与牙本质中膨松的胶原纤维网形成杂化层

正确答案：D。与牙本质中膨松的胶原纤维网形成杂化层

解析：本题考查牙本质湿粘接。牙本质湿粘接能提高粘接强度的主要原因是与牙本质中膨松的胶原纤维网形成杂化层（D对）。湿粘接技术，就是首先用某种酸溶液处理牙本质表面，使牙本质发生一定程度的脱矿，然后在粘接剂涂布之前牙本质表面必须保持一定的湿润度，以利于粘接剂的渗透和较为理想的粘接界面的形成，从而达到最佳的粘接效果。其基本原理是酸处理使牙本质表层部分脱钙，形成了富含胶原纤维的变性的纤维网状结构。湿润的牙本质表面的水分可以支持胶原纤维的网状结构，以利于随后粘接剂的底料的渗透。为了获得较好的牙本质粘接，粘接底料要有良好的向脱矿后的胶原网中渗透的能力；可以通过提高底料的湿润性来达到，但也要求在底料渗透前保持胶原网的膨胀状态；渗透的底料应能与水分混合、而后去除水分，但不引起胶原网的塌陷，从而使渗透的底料在胶原网中的密度能保持最高。目前普遍认为过分干燥牙本质将使脱矿牙本质中的纤维网状结构塌陷，在牙本质表面形成一层致密的纤维层，同时使暴露的管间胶原纤维中的微孔隙关闭，阻止亲水性底料的充分渗透。